抗室性心律失常，抗癫痫
A. 苯妥英钠
B. 胺碘酮
C. 维拉帕米
D. 地高辛
E. 普罗帕酮

正确答案：A。苯妥英钠